架于肩关节上方的是
A. 前臂骨间膜
B. 黄韧带
C. 前纵韧帮
D. 喙肩韧带
E. 喙肱韧带

正确答案：D。喙肩韧带

解析：喙间韧带（D对）与喙突、肩峰构成喙肩弓、架于肩关节上方。